不支持新生儿化脓性脑膜炎临床表现是
A. 苦笑面容
B. 吐奶
C. 面色青灰发绀
D. 拒食少动
E. 黄疸

正确答案：A。苦笑面容

解析：新生儿化脓性脑膜炎时，由于感染中毒及急性脑功能障碍，婴幼儿可出现面色青灰发绀（C对）、拒食少动（D对）、黄疸（E对）；由于颅内压增高，不典型的患儿可表现为吐奶（B对）。苦笑面容为肌肉阵发性或强直性痉挛，由破伤风梭菌感染引起（A错，为本题正确答案）。